关于脊髓灰质炎病毒，哪项是错误的
A. 主要经粪口途径传播
B. 为无包膜RNA病毒，分为I、Ⅱ、Ⅲ型
C. 多见于成人发病
D. 主要感染脊髓前角运动神经细胞
E. 属于人类肠道病毒C种

正确答案：C。多见于成人发病

解析：脊髓灰质炎病毒（简称脊灰病毒，PV）分为I、Ⅱ、Ⅲ血清型，三个血清型之间缺乏共同的抗原。新命名系统中脊灰病毒属于人类肠道病毒C种（HEV-C）。脊灰病毒引起脊髓灰质炎。主要通过粪-口途径传播，亦可经密切接触及飞沫传播。多见于儿童发病，病毒可侵犯脊髓前角运动神经细胞，引起暂时性或永久性弛缓性肢体麻痹，故亦称小儿麻痹症。在脊灰病毒感染的人群中，占90%以上的人尤其是成人，于病毒感染后不出现或只出现轻微临床症状，称为隐性感染或亚临床感染，只占0.1%～2%的感染者出现麻痹症状，并可遗留后遗症。掌握“胃肠道病毒”知识点。